中央尖折断或被磨损后，临床上表现为圆形或椭圆形黑环，中央有时可见到黑色小点，此点为
A. 牙釉质
B. 牙本质
C. 牙髓髓角
D. 牙骨质
E. 继发牙本质

正确答案：C。牙髓髓角

解析：有半数的中央尖有髓角伸入。中央尖折断或被磨损后，临床上表现为圆形或椭圆形黑环，中央有浅黄色或褐色的牙本质轴；在轴中央有时可见到黑色小点，此点就是髓角。掌握“畸形中央尖”知识点。